急非淋白血病最佳诱导治疗缓解方案
A. VP
B. ATRA
C. DA
D. CHOP
E. MTX

正确答案：C。DA

解析：急性非淋巴细胞白血病的治疗分为非急性早幼粒细胞白血病的治疗和急性早幼粒细胞白血病（APL）的治疗，非急性早幼粒细胞白血病最佳诱导治疗缓解方案为DA（柔红霉素+阿糖胞苷）方案；急性早幼粒细胞白血病最佳诱导治疗缓解方案为ATRA （全反式维A酸），故最佳答案应为DA（C对B错）；VP方案（P575）（A错）为急性淋巴细胞白血病的诱导缓解方案；CHOP方案（环磷酰胺+阿霉素+长春新碱+泼尼松）（P590）（D错）为侵袭性非霍奇金淋巴瘤的标准治疗方案；MTX（甲氨喋呤）（P575）（E错）为中枢神经系统白血病的常用化疗药物。